小剂量可治疗亚硝酸盐食物中毒的解毒剂是
A. 氟马西尼
B. 维生素K₁
C. 维生素B₆
D. 普萘洛尔
E. 亚甲蓝

正确答案：E。亚甲蓝

解析：本题考查亚硝酸盐中毒解救。小剂量可治疗亚硝酸盐食物中毒的解毒剂是亚甲蓝（E对）。亚甲蓝（美蓝） 用于氰化物中毒，小剂量可治疗高铁血红蛋白血症（亚硝酸盐中毒等）。氟马西尼（A错）用于苯二氮䓬类药物过量或中毒。维生素K₁（B错）是香豆素类灭鼠药的特效解毒剂。维生素B₆（C错）可与维生素B₁及烟酸同时肌肉注射以缓解急性乙醇中毒。普萘洛尔（D错）用于瘦肉精重度中毒。